国家提倡
A. 无偿献血制度
B. 无偿义务献血制度
C. 18周岁至55周岁健康公民自愿献血
D. 18周岁至50周岁健康公民自愿献血
E. 国家工作人员现役军人和高等学校在校学生率先献血

正确答案：C。18周岁至55周岁健康公民自愿献血

解析：《献血法》规定，国家提倡18周岁至55周岁的健康公民自愿献血（C对D错）。《献血法》规定，我国实行无偿献血制度（A错）（P306）。国家鼓励国家工作人员、现役军人和高等学校在校学生率先献血（E错），为树立社会新风尚作表率（P307）。